依照国家有关规定享受财政补贴税收减免等优惠政策的是
A. 获得定点资格的中医医疗机构
B. 中医药人员培训规划
C. 中医药专业技术职务任职资格评审
D. 非营利性中医医疗机构
E. 与中医药有关的评审或者鉴定活动

正确答案：D。非营利性中医医疗机构

解析：《中华人民共和国中医药法》第二十六条 非营利性中医医疗机构（D对），依照国家有关规定享受财政补贴、税收减免等优惠政策（ABCE错）。